急性血吸虫病的热型最常见的是
A. 稽留热
B. 不规则热
C. 间歇热
D. 回归热
E. 波状热

正确答案：C。间歇热